最早设妇科专篇的医著是
A. 《黄帝内经》
B. 《金匮要略》
C. 《脉经》
D. 《千金要方》
E. 《景岳全书》

正确答案：B。《金匮要略》

解析：《黄帝内经》对妇科从基础理论到临床病证的认识，奠定了妇科学的理论和临床基础（A错）。汉代张仲景《金匮要略》设有“妇人妊娠病脉证并治”、“妇人产后病脉证治”、“妇人杂病脉证并治”三篇，是现存中医古籍中最早设妇产科专篇的医著（B对）。《脉经》首先提出了根据脉象变化推断崩漏的预后；还总结了妇科脉证的新经验（C错）。《千金要方》孙思邈在《备急千金要方》中专设“妇人方”3卷，并列于卷首（D错）。《景岳全书》所指的“无形之水”的产生及功能，与西医内分泌的概念颇为相似，并根据阴阳水火之论和阴阳互根学说创制了左归丸、右归丸传之于世，成为妇科沿用至今的著名方剂（E错）。